围绕颞上沟后端的脑回叫
A. 舌回
B. 角回
C. 缘上回
D. 枕颞外侧回
E. 枕颞内侧回

正确答案：B。角回

解析：围绕颞上沟后端的脑回叫角回（B对）。舌回（A错）为位于距状沟下方的脑回。缘上回（C错）为包绕外侧沟后端的脑回。枕颞外侧回（D错）为位于枕颞沟外侧的脑回。枕颞内侧回（E错）为位于侧副沟与枕颞沟间的脑回。